依照《中华人民共和国药品管理法》，国务院药品监督管理部门会同国务院中医药管理部门制定
A. 实施批准文号管理的中药材、中药饮片品种目录
B. 组织药典委员会，负责国家药品标准的制定和修订
C. 实行处方药与非处方药分类管理制度的具体办法
D. 实行药品不良反应报告制度的具体办法
E. 药物临床试验机构资格的认定办法

正确答案：A。实施批准文号管理的中药材、中药饮片品种目录

解析：本题考查药品研制和注册。依照《中华人民共和国药品管理法》，国务院药品监督管理部门会同国务院中医药管理部门制定实施批准文号管理的中药材、中药饮片品种目录（A对）。《中华人民共和国药品管理法》第二章药品研制和注册第二十四条：在中国境内上市的药品，应当经国务院药品监督管理部门批准，取得药品注册证书；但是，未实施审批管理的中药材和中药饮片除外。实施审批管理的中药材、中药饮片品种目录由国务院药品监督管理部门会同国务院中医药主管部门制定。申请药品注册，应当提供真实、充分、可靠的数据、资料和样品，证明药品的安全性、有效性和质量可控性。